产后出血的治疗原则是
A. 塞流澄源复旧
B. 急则治其标，缓则治其本
C. 调理气血冲任
D. 虚者补之，实者泻之
E. 热者清之，逆则降之

正确答案：B。急则治其标，缓则治其本

解析：产后出血的治疗原则是急则治其标，缓则治其本。以调理气血、固摄冲任为主要治法（B对）。塞流澄源复旧是崩漏的治疗方法（A错）。调理气血冲任是冲任不调的治疗方法（C错）。虚者补之，实者泻之是补虚泻实的治疗原则（D错）。热者清之，逆则降之是治疗倒经的原则（E错）。